鳞状细胞癌的特点是
A. 富于细胞的纤维组织和表现多样的矿化组织
B. 是一种少见的原发性牙源性恶性肿瘤
C. 酸性粒细胞增多
D. 又称外周性巨细胞肉芽肿
E. 异常增生的上皮细胞突破基底膜向间质浸润性生长

正确答案：E。异常增生的上皮细胞突破基底膜向间质浸润性生长

解析：鳞状细胞癌主要病理变化是异常增生的上皮细胞突破基底膜向间质浸润性生长。骨化纤维瘤是一种富于细胞的纤维组织和表现多样的矿化组织构成的病变。巨细胞性龈瘤又称外周性巨细胞肉芽肿。成釉细胞癌是一种少见的原发性牙源性恶性肿瘤。嗜酸性淋巴肉芽肿表现为酸性粒细胞增多。掌握“口腔黏膜鳞癌及疣状癌”知识点。